急性大失血导致尿量改变的机制是
A. 肾小球毛细血管血压升高
B. 血浆晶体渗透压升高
C. 囊内压升高
D. 抗利尿激素分泌减少
E. 肾血流量减少

正确答案：E。肾血流量减少

解析：急性失血时，血量减少，血压下降，可反射性得兴奋肾交感神经，引起肾入球小动脉强烈收缩，肾血流量减少（E对），肾小球毛细血管血压下降（A错），肾小球率过滤降低，囊内压减低（C错），尿量生成减少。急性失血时，循环血量减少，静脉回心血量减少，对心肺感受器的刺激减弱，经迷走神经传入至下丘脑的冲动减少，对血管升压素释放的抑制作用减弱或取消，故血管升压素释放增加（D错）。急性失血时，血浆晶体渗透压不变（B错）。